下列哪项慢性盘状红斑狼疮实验室检查结果不正确
A. OKT₄/OKT₈比例降低
B. 血沉加快
C. 球蛋白增高
D. 类风湿因子阳性
E. 抗核抗体阳性

正确答案：A。OKT₄/OKT₈比例降低

解析：本题考查盘状红斑狼疮的辅助检查。OKT₄/OKT₈比值为T淋巴细胞功能的一种非特异性测定方法，比值下降主要见于AIDS（艾滋病），而非慢性盘状红斑狼疮（A错，为本题的正确答案）。慢性盘状红斑狼疮实验室检查有常规检查和抗核抗体及其他免疫指标两种。患者可出现血沉加（B对）、球蛋白增高（C对）、类风湿因子阳性（D对）、抗核抗体阳性（E对）。